一侧肾自截，对侧肾积水
A. 非手术抗结核治疗
B. 积水肾造瘘术
C. 抗结核治疗后双肾移植
D. 肾大部切除术后抗结核治疗
E. 脊柱矫形术

正确答案：B。积水肾造瘘术

解析：肾自截（P545）患者因肾内结核病灶钙化形成的干酪样物质堵塞输尿管，使得含有结核杆菌的尿液不能流入膀胱，膀胱的继发性结核病变逐渐缓解甚至消失，常因尿液检查趋于正常而忽视了其原发病灶，但此时自截侧肾脏多已达到终末期，病损严重，需行患肾切除。对侧肾积水时，应先行积水肾造瘘术（B对），引流肾积水，保护该侧肾功能，待功能好转后再切除无功能的患肾。肾自截患者的患肾广泛钙化、功能已完全丧失，需行患肾全切（AD错）。对侧积水肾肾功能可能完好，无需行双肾移植（C错）。本题尚未提示有脊柱畸形，无需行脊柱矫形术（E错）。